牙周病造成牙齿松动的原因不包括
A. 牙周韧带炎症
B. （牙合）创伤
C. 牙槽骨吸收
D. 夜磨牙
E. 牙根纵裂

正确答案：E。牙根纵裂

解析：本题考查牙松动的原因。牙周病造成牙齿松动的原因不包括牙根纵裂（E错，为本题的正确答案）。在病理情况下，牙松动超过生理范围，这是牙周炎的主要临床表现之一。引起牙松动的原因如下：1.牙槽嵴吸收：牙槽嵴的吸收（C对）使牙周支持组织减少，是牙松动最主要的原因。2.（牙合）创伤（B对）：常见者如夜磨牙（D对）、紧咬牙、早接触及牙尖干扰、过高的修复体及正畸加力过大等。急性外伤也可使牙松动甚至脱臼。3.牙周膜急性炎症（A对）：如急性根尖周炎或牙周脓肿等可使牙明显松动，这是由于牙周膜充血水肿及渗出所致。急性炎症消退后牙齿可恢复稳固。4.牙周翻瓣手术后：由于手术的创伤及部分骨质的去除，组织水肿，牙齿有暂时性动度增加。一般在术后数周牙齿即能逐渐恢复稳固。